锥体交叉
A. 由皮质脊髓束的大部分纤维左、右交叉形成
B. 由皮质脊髓束的全部纤维左、右交叉形成
C. 由锥体束的全部纤维左、右交叉形成
D. 由锥体束的大部分纤维左、右交叉形成
E. 位于锥体的上方

正确答案：A。由皮质脊髓束的大部分纤维左、右交叉形成

解析：锥体交叉由皮质脊髓束的大部分纤维左、右交叉形成（A对）。